药效学相互作用不包括
A. 相加作用
B. 增强作用
C. 增敏作用
D. 药理性拮抗
E. 药物间的吸附和络合

正确答案：E。药物间的吸附和络合

解析：药物间的吸附和络合（E错，为本题正确答案）属于药物间发生的物理变化，可能会影响药效，但不属于药效学相互作用。药物联用药效学方面具有协同作用，拮抗作用以及无关作用，其中协同作用包括相加作用（A对），即两药合用后的作用是两药分别作用的代数和；增强作用（B对）是指两药合用后的作用大于它们分别作用的代数和；增敏作用（C对）是指一药可使阻止或受体对另一药的敏感性增强。拮抗作用是指药物合用后原有作用或毒性减弱，根据其产生机制可分为4种情况，即药理性拮抗、生理性拮抗、生化性拮抗以及化学性拮抗，其中药理性拮抗（D对）是指一种药物与受体结合可阻止激动药与此受体结合，如纳洛酮可拮抗吗啡的作用。